主动脉瓣关闭不全可出现的脉搏
A. 水冲脉
B. 交替脉
C. 脉搏短绌
D. 重搏脉
E. 奇脉

正确答案：A。水冲脉

解析：主动脉瓣关闭不全由于动脉收缩压增高，舒张压降低，脉压增宽，可出现周围血管征，如点头征（De Musset征）、水冲脉（A对）、股动脉枪击音（Traube征）和毛细血管搏动征，听诊器压迫股动脉可闻及双期杂音（Duroziez双重音）。交替脉（B错）一般认为是左室收缩力强弱交替所致，是左室心力衰竭的重要体征之一；脉搏短绌（C错）为房颤的典型表现，是由于许多心室搏动过弱以致未能开启主动脉瓣，或因动脉血压波太小，未能传导至外周动脉所致；重搏脉（D错）指正常脉搏在其下降期中有一重复上升的脉搏，但较第一个波低，不能触及，常见于肥厚梗阻性心肌病、伤寒及长期发热使外周血管紧张度降低等；奇脉（E错）指吸气时脉搏明显减弱或消失，系左心室搏血量减少所致，多见于心包积液、重症哮喘等。